应用地西泮催眠，次晨出现的乏力，困倦等反应属于
A. 变态反应
B. 特异质反应
C. 毒性反应
D. 副反应
E. 后遗效应

正确答案：E。后遗效应

解析：本题考查药物的不良反应。应用地西泮催眠，次晨出现的乏力，困倦等反应属于后遗效应（E对）。后遗效应是指在停药后，血药浓度已降至最小有效浓度以下时残存的药理效应。例如，服用巴比妥类催眠药后，次晨出现的乏力、困倦等“宿醉”现象；长期应用肾上腺皮质激素，可引起肾上腺皮质萎缩，一旦停药，可出现肾上腺皮质功能低下，数月难以恢复。过敏反应又称变态反应（A错），是指机体受药物刺激所发生异常的免疫反应，引起机体生理功能障碍或组织损伤，如微量的青霉素可引起过敏性休克。特异质反应（B错）是指少数特异体质患者对某些药物反应异常敏感。毒性反应（C错）是指在药物剂量过大或体内积蓄过多时发生的危害机体的反应。副作用或副反应（D错）是指在药物按正常用法用量使用时，出现的与治疗目的无关的不适反应，例如阿托品用于解除胃肠痉挛时，会引起口干、心悸、便秘等副作用。